视黄醇含量最多的食物是
A. 动物肝脏
B. 蔬菜
C. 肉类
D. 豆类
E. 粮谷类

正确答案：A。动物肝脏